既降气祛痰，又宣散风热的药是
A. 白前
B. 前胡
C. 桔梗
D. 桑叶
E. 金银花

正确答案：B。前胡

解析：本题考查前胡的功效。既降气祛痰，又宣散风热的药是前胡（B对）。前胡【功效】降气祛痰，宣散风热。白前（A错）【功效】降气祛痰止咳。桔梗（C错）【功效】宣肺，利咽，祛痰，排脓。桑叶（D错）【功效】疏散风热，清肺润燥，平肝明目，凉血止血。金银花（E错）【功效】清热解毒，疏散风热。